在进行牙周病流行病学调查时，WHO推荐使用
A. 牙龈指数
B. 龈沟出血指数
C. 简化口腔卫生指数
D. 菌斑指数
E. 社区牙周指数

正确答案：E。社区牙周指数

解析：1997年口腔健康调查基本方法第4版对社区牙周治疗需要指数作了修改，取名社区牙周指数。这个指数操作简便，重复性好，适合于大规模的口腔流行病学调查。掌握“牙周病流行病学及分级预防”知识点。